胎心率晚期减速的原因
A. 胎儿缺氧
B. 胎动
C. 子宫收缩
D. 胎头受压
E. 胎盘功能减低

正确答案：E。胎盘功能减低

解析：胎心率晚期减速的原因一般认为是胎盘功能不良（E对）、胎儿缺氧。早期减速为宫缩时胎头受压（D错）引起，不受孕妇体位或吸氧而改变。缺氧早期，胎儿电子监护可出现胎心基线代偿性加快、晚期减速或重度变异减速（A错），胎动（B错）和子宫收缩（C错）仅能引起胎心率一过性变化。